母乳喂养儿，其大便的特点是
A. 色暗褐，味腐臭
B. 色淡黄，质较硬
C. 色金黄，稍酸臭
D. 色橘黄，味臭秽
E. 色黄绿，无臭味

正确答案：C。色金黄，稍酸臭

解析：单纯母乳喂养的婴儿，由于母乳中含有蛋白质、碳水化合物、矿物质及各种维生素，经肠道细菌水解后大便呈金黄色，稍酸臭（C对）。大便色暗褐，味腐臭可见于急性坏死性肠炎（A错）。牛乳、羊乳为主喂养者，大便色淡黄，质较干硬，有臭气（B错）。大便色橘黄，味臭秽，为肠腑湿热（D错）。大便色黄绿，无臭味，可见于消化不良或母乳喂养不足（E错）。